我国水环境标准体系可概括为“六类三级”，其中“三级”是指
A. 国家级标准、省级标准和市级标准
B. 一级标准、二级标准和三级标准
C. 国家标准、地方标准和专业标准
D. 行业标准、地区标准和特殊标准
E. 国家标准、行业标准和地方标准

正确答案：E。国家标准、行业标准和地方标准

解析：本题考查我国水环境标准体系。我国水环境标准体系可概括为“六类三级”，即水环境质量标准、水污染物排放标准、水环境卫生标准、水环境基础标准、水监测分析方法标准和水环境标准样品标准六类，标准又分为国家级标准、行业标准和地方标准三级（E对ABCD错）。